在脾胃的相互关系中，最根本的是
A. 脾燥胃湿，燥湿相济
B. 太阴湿土得阳始运，阳明燥土得阴自安
C. 胃主纳谷，脾主磨谷
D. 脾主升清，胃主降浊
E. 胃为水谷之海，脾为胃行其津液

正确答案：D。脾主升清，胃主降浊

解析：脾胃同居中焦，脾为阴土，胃为阳土。脾气主升，以升为顺；胃气主降，以降为和。脾升与胃降，相反相成。脾胃之气，一升一降，升降相因，从而保证食物的正常消化（D对）。脾与胃同居中焦，以膜相连，足太阴经属脾络胃，足阳明经属胃络脾，两者构成表里配合关系。脾胃同为气血生化之源、后天之本，在水饮食物的受纳、消化及水谷精微的吸收、转输等生理过程中起主要作用。脾与胃的关系，体现为水谷纳运相得、气机升降相因、阴阳燥湿相济三个方面。但是，在脾胃的关系中，最根本的是脾主升清，胃主降浊（ABCE错）。